《文化娱乐场所卫生标准》规定，文化娱乐场所动态噪声不超过
A. 75dB（A）
B. 85dB（A）
C. 95dB（A）
D. 80dB（A）
E. 70dB（A）

正确答案：B。85dB（A）

解析：本题考查《文化娱乐场所卫生标准》。《文化娱乐场所卫生标准》规定，文化娱乐场所动态噪声不超过85dB（A）（B对ACDE错），静态噪声不应超过55dB（A）。